以下哪种不是粘附分子家族
A. 粘附素家族
B. 选择素家族
C. 免疫球蛋白超家族
D. 钙粘蛋白家族
E. 钙调蛋白家族

正确答案：E。钙调蛋白家族

解析：细胞粘附分子（CAM）是指介导细胞与细胞间或细胞与细胞外基质（ECM）相互结合作用的跨膜糖蛋白，包括整合素、选择素、黏蛋白样血管地址素、免疫球蛋白超家族和钙粘蛋白。掌握“白细胞分化抗原及黏附分子”知识点。